镇痛药枸橼酸芬太尼属于
A. 氨基酮类
B. 哌啶类
C. 吗啡烃类
D. 苯吗喃类
E. 其他类

正确答案：B。哌啶类

解析：本题考查哌替啶类镇痛药。镇痛药枸橼酸芬太尼属于哌啶类（B对）。对4-苯基哌啶类进行进一步的结构修饰，在苯基和哌啶之间插入N-原子得到4-苯氨基哌啶类的芬太尼。镇痛药可分为天然生物碱及其类似物、哌啶类、氨基酮类及其他合成镇痛药。吗啡烃类（C错）和苯吗喃类（D错）均属于天然生物碱及其类似物。氨基酮类（A错）代表药物是美沙酮。其他合成镇痛药（E错）有布桂嗪（又名强痛定）、曲马多。